某男，60岁。胃癌晚期，胃脘刺痛，倦怠乏力，不欲饮食，嗳气呕恶，身体消瘦；舌淡有瘀点，脉弦细弱。应采用的治疗原则是
A. 扶正
B. 祛邪
C. 祛邪为主兼以扶正
D. 先扶正后祛邪
E. 先祛邪后扶正

正确答案：D。先扶正后祛邪

解析：本题考查的是扶正祛邪的治疗原则。某男，60岁。胃癌晚期，胃脘刺痛，倦怠乏力，不欲饮食，嗳气呕恶，身体消瘦；舌淡有瘀点，脉弦细弱。应采用的治疗原则是先扶正后祛邪（D对）。先扶正后祛邪适用正虚邪实，以正虚为主的病证。因正气过于虚弱，若兼以攻邪，则反而更伤正气，故应先扶正而后祛邪。如某些虫积患者，因正气太虚弱，不宜驱虫，应先健脾以扶正，使正气得到一定恢复之时，然后再驱虫消积。扶正（A错）适用于以正气虚为主要矛盾，而邪气也不盛的虚性病证。如补法，包括补气、助阳、滋阴、养血等，为扶正治则指导下的具体治法。祛邪（B错）适用于以邪实为主要矛盾，而正气未衰的实性病证。如汗法、吐法、下法、清法、消法等，皆属祛邪治则指导下的具体治法。扶正与祛邪兼用又称“攻补兼施”，适用于正虚邪实病证，两者同时兼用，则扶正不留邪，祛邪又不会伤正。在具体应用时，还要分清以正虚为主，还是以邪实为主。正虚较急重的，应以扶正为主，兼顾祛邪；而邪实较急重的，则以祛邪为主，兼顾扶正（C错）。先祛邪后扶正（E错）适用于虽为邪盛正虚，但正气尚能耐攻，或同时兼顾扶正反会助邪的病证。如瘀血所致的崩漏证，瘀血不去，则崩漏难止，故应先用活血祛瘀法，然后补血。